下颌骨X线片显示有明显的骨密质增生，骨质呈致密影像的颌骨骨髓炎是
A. 中央性颌骨骨髓炎急性期
B. 中央性颌骨骨髓炎慢性期
C. 边缘性颌骨骨髓炎增生型
D. 边缘性颌骨骨髓炎溶解破坏型
E. 新生儿颌骨骨髓炎

正确答案：C。边缘性颌骨骨髓炎增生型

解析：本题考查下颌骨边缘性颌骨骨髓炎增生型的X线表现。下颌骨边缘性颌骨骨髓炎增生型X线片见有明显的骨密质增生，骨密质呈致密影像（C对）；溶解破坏型X线片可见病变区骨密质破坏，骨质疏松脱钙，形成不均匀的骨粗糙面（D错）。中央性颌骨骨髓炎的急性期X线表现为不同程度的单发或多发低密度影（A错）；慢性期有死骨形成，密度较高且界限清楚，或为线状骨膜反应、带状低密度影像（B错）。新生儿颌骨骨髓炎病变早期X线表现无异常，晚期病变颌骨破坏广泛，为不规则骨质密度减低，有死骨形成及牙胚移位、缺失，死骨脱落而导致颌骨畸形（E错）。